属于环烯醚萜类化合物的化合物有
A. 黄芪甲苷
B. 栀子苷
C. 苦杏仁苷
D. 甜菊苷
E. 京尼平苷

正确答案：B、E。栀子苷；京尼平苷

解析：本题考查的是环烯醚萜类化合物。属于环烯醚萜类化合物的化合物有栀子苷（B对）与京尼平苷（E对）。烯醚萜类为臭蚁二醛的缩醛衍生物，属单萜化合物。可分为环烯醚萜苷及裂环烯醚萜苷两大类。1）环烯醚萜苷：①C-4位有取代基的环烯醚萜苷：如存在于清热泻火中药栀子中的主要有效成分栀子苷、京尼平苷和京尼平酸等；存在于鸡屎藤中的主要成分鸡屎藤苷。②4-去甲基环烯醚萜苷：如地黄中的降血糖有效成分梓醇、梓苷；2）裂环烯醚萜苷：如龙胆中主要有效成分和苦味成分龙胆苦苷，獐牙菜中的苦味成分獐牙菜苷及獐牙菜苦苷等。黄芪甲苷（A错）是黄芪的主要活性成分，属于皂苷类。苦杏仁苷（C错）为苦杏仁、桃仁与郁李仁的含量测定成分，属于氰苷。甜菊苷（D错）味菊科植物甜叶菊中所含的甜味苷，属于四环二萜。